更年期占妇女一生的时间是
A. 1/7
B. 1/6
C. 1/5
D. 1/4
E. 1/3

正确答案：E。1/3

解析：本题考查更年期占妇女一生的时间。女性更年期不是一种需要治疗的疾病，而是卵巢功能从旺盛状态逐渐衰退到完全消失的一段过渡时期。更年期大约从40岁开始，妇女在其一生中的1/3（E对ABCD错）的时间是在更年期度过的。